执业药师在合理用药方面应尽的职责有
A. 积极向患者推荐新药、贵重药和进口药
B. 向患者介绍药物的治疗作用和不良反应
C. 建立患者药历，进行用药咨询
D. 及时发现药物不良反应，并逐级报告，评价上市药物的稳定性和疗效
E. 定期进行处方和病历分析，找出不合理用药原因

正确答案：B、C、D、E。向患者介绍药物的治疗作用和不良反应；建立患者药历，进行用药咨询；及时发现药物不良反应，并逐级报告，评价上市药物的稳定性和疗效；定期进行处方和病历分析，找出不合理用药原因